对决明子描述正确的是
A. 外表面灰棕色或黄棕色
B. 有香气
C. 两者均是
D. 两者均不是

正确答案：D。两者均不是

解析：本题考查的是决明子药材的性状鉴别。决明子表面绿棕色或暗棕色、气微（D对）。决明子：【性状鉴别】药材决明略呈菱状方形或短圆柱形，两端平行倾斜。表面绿棕色或暗棕色（A错），平滑有光泽。一端较平坦、另端斜尖，背腹面各有1条突起的棱线，棱线两侧各有1条斜向对称而色较浅的线形凹纹。质坚硬，不易破碎。种皮薄，子叶2，黄色，呈“S”形折曲并重叠。气微（B错），味微苦。